硬脑膜构成的结构不包括
A. 大脑镰
B. 小脑幕
C. 鞍隔
D. 胼胝体
E. 小脑镰

正确答案：D。胼胝体

解析：硬脑膜是厚而坚韧的双层膜，其构成了大脑镰（A对）（分隔两大脑半球）、小脑幕（B对）（分隔大脑和小脑）、小脑镰（E对）（自小脑幕下面正中伸入两小脑半球之间）、鞍膈（C对）（位于蝶鞍上方，封闭垂体窝）。而胼胝体（P368）（D错，为本题正确答案）是连接左、右大脑半球的宽厚的纤维束板，其位于大脑纵裂的底面。